以下哪项不属于根管治疗完毕后永久性修复的目的
A. 阻止冠方的微渗漏
B. 恢复牙齿的咬合功能
C. 恢复牙齿的美学特性
D. 恢复牙齿的（牙合）关系
E. 恢复牙周组织健康状态

正确答案：E。恢复牙周组织健康状态

解析：本题考查疗效评定与牙体修复原则。恢复牙周组织健康状态（E错，为本题正确答案）不属于根管治疗完毕后永久性修复的目的。永久性修复既要阻止冠方的微渗漏（A对），还必须尽可能地恢复牙齿的咬合功能（B对）和美学特性（C对）、恢复牙齿的（牙合）关系（D对）。